现况研究中所用的指标主要是
A. 发病率
B. 病死率
C. 患病率
D. 感染率
E. 死亡率

正确答案：C。患病率

解析：本题考查现况研究的概念。现况研究又称为患病率研究（C对ABDE错），是通过对特定时点（或期间）和特定范围内人群中的疾病或健康状况和有关因素的分布状况的资料收集、描述，从而为进一步的研究提供病因线索。